提示病情危重的异常姿态是
A. 颤动
B. 抽搐
C. 撮空
D. 痿废
E. 麻痹

正确答案：C。撮空

解析：患者循衣摸床，撮空理线是指重病患者意识不清，不自主地伸手抚摸衣被、床沿，或伸手向空中，手指时分时合，为病重失神的表现（C对）。颤动若见于外感热病，多为热盛动风；若见于内伤虚证，多为血虚阴亏，经脉失养，属虚风内动（A错）。四肢抽搐多因肝风内动，筋脉拘急所致，可见于惊风、痛病（B错）。肢体痿废多见于痿病，因肺热伤津，或湿热浸淫，或脾胃虚弱，或肝肾亏虚，或外伤瘀血阻滞所致。若一侧上下肢痿废不用者，称为半身不遂，多见于中风患者；若双下肢痿废不用者，见于截瘫患者（D错）。麻痹多为神经系统器质性受损所致（E错）。